使慢性粒细胞白血病达到血液学缓解的首选药物是
A. 白消安
B. 羟基脲
C. 靛玉红
D. α干扰素
E. 环磷酰胺

正确答案：B。羟基脲

解析：过去认为：能使慢性粒细胞白血病达到血液学缓解的首选药物是羟基脲（B对）；能使慢性粒细胞白血病达到遗传学缓解的首选药物是α干扰素（D错）。现九版内科学认为分子靶向药物甲磺酸伊马替尼是慢性粒细胞白血病治疗的首选药物，可使患者血液学和遗传学获得较高的缓解率。白消安（A错）、靛玉红（C错）均可用于慢性粒细胞白血病的治疗，但血液学缓解率不高；环磷酰胺（E错）可用于恶性淋巴瘤、多发性骨髓瘤、急性或慢性淋巴细胞白血病、乳腺癌等的治疗。